慢性肾盂肾炎是指
A. 累及肾实质和肾盂黏膜的慢性炎症
B. 累及肾间质和肾盂黏膜的慢性炎症
C. 累及肾皮质和肾盂黏膜的慢性炎症
D. 累及肾髓质和肾盂黏膜的慢性炎症
E. 累及肾实质、间质和肾盂黏膜的慢性炎症

正确答案：B。累及肾间质和肾盂黏膜的慢性炎症

解析：慢性肾盂肾炎是指肾小管-间质的慢性炎症，常累及肾间质和肾盂黏膜（B对）。